白求恩医德境界的最佳概括是
A. 对工作极端的负责任
B. 毫无自私自利之心
C. 国际主义精神
D. 对技术精益求精，毫不利己专门利人
E. 对同志对人民极端的热忱

正确答案：D。对技术精益求精，毫不利己专门利人

解析：毛泽东同志在《纪念白求恩》一文中指出：“白求恩同志毫不利己专门利人的精神，表现在他对工作的极端的负责任，对同志对人民的极端的热忱。每个共产党员都要学习他”（D对）。